采集病原微生物样本应当具备下列条件，但不包括
A. 具有与采集病原微生物样本所需要的生物安全防护水平相适应的设备
B. 具有掌握相关专业知识和操作技能的工作人员
C. 具有有效地防止病原微生物扩散和感染的措施
D. 具有保证病原微生物样本质量的技术方法和手段
E. 具有保证病原微生物样本安全储存的设备和措施

正确答案：E。具有保证病原微生物样本安全储存的设备和措施